以下根管预备的操作哪个是错误的
A. 使用扩孔锉和扩孔钻，由细到粗，依序号进行
B. 根管口可用球钻、大号扩孔钻或裂钻扩大
C. 对于根管狭窄、钙化或根管内异物可用螯合剂乙二胺四乙酸来处理
D. 凡旋转使用的器械，一般旋转时不要超过半圈
E. A+C+D

正确答案：B。根管口可用球钻、大号扩孔钻或裂钻扩大

解析：本题考查根管预备。根管口预备时应用G钻从小到大、由细到粗依次预备根管口，不应用球钻、大号扩孔钻或裂钻，以防引起侧穿或底穿（B错，为本题的正确答案）。根管预备时使用扩孔锉和扩孔钻，由细到粗，依序号进行（A对），不要跳号，以免引起器械折断。螯合剂乙二胺四乙酸有润滑根管、溶解钙化物的作用，可用来处理根管狭窄、钙化或根管内异物（C对）。在用器械预备根管时，旋转圈数不要过半（D对），否则有可能引起器械折断于根管内，给治疗带来困难。